中气下陷的辨证要点是
A. 头晕目眩，少气懒言
B. 头目昏花，腹部坠胀
C. 头痛眩晕，面红目赤
D. 头重如裹，胸胁满闷
E. 头晕耳鸣，腰膝酸软

正确答案：B。头目昏花，腹部坠胀

解析：本题考查的是气陷证的临床表现。中气下陷的辨证要点是头目昏花，腹部坠胀（B对）。气陷证的临床表现，常见头目昏花，少气倦怠，腹部有坠胀感，脱肛或子宫脱垂等，舌淡苔白，脉弱。头晕目眩，少气懒言（A错）为气虚证的临床表现。气虚证的临床表现，常见头晕目眩，少气懒言，疲倦乏力，自汗，活动时诸症加剧，舌淡，脉虚无力。头痛眩晕，面红目赤（C错）为肝火上炎证的临床表现。肝火上炎证临床表现，常见头痛眩晕，耳聋耳鸣，面红目赤，口苦，尿黄，甚则咯血、吐血、衄血，舌红苔黄，脉弦数。头重如裹，胸胁满闷（D错）为眩晕痰湿中阻证的症状。眩晕痰湿中阻证：【症状】眩晕，头重昏蒙，或伴视物旋转，胸闷恶心，呕吐痰涎，食少多寐。舌苔白腻，脉濡。【治法】化痰祛湿，健脾和胃。【方剂应用】基础方剂为半夏白术天麻汤（半夏、白术、天麻、橘红、茯苓、甘草、生姜、大枣）加减。【中成药应用】常用中成药有半夏天麻丸、眩晕宁颗粒、晕复静片。头晕耳鸣，腰膝酸软（E错）为肝阳上亢证的临床表现。肝阳上亢证的临床表现及辨证要点：肝阳上亢证临床表现，常见头痛、头胀、眩晕，时轻时重，耳鸣耳聋，口燥咽干，两目干涩，失眠健忘，腰膝酸软，舌红少津，脉多弦而有力。一般以肝阳亢于上而肾阴亏于下的症状表现作为辨证要点。